脾肾韧带内有
A. 胰体
B. 脾静脉
C. 左肾静脉
D. 门静脉
E. 胃左静脉

正确答案：B。脾静脉

解析：脾肾韧带内有胰尾（A错）、脾静脉（B对）、脾动脉、淋巴、神经等。